肾所摄纳之气是
A. 精气
B. 元气
C. 宗气
D. 清气
E. 营气

正确答案：D。清气

解析：肾具有摄纳肺吸入的清气而维持正常呼吸的功能（D对），肾气摄纳肺所吸入的自然界清气，保持吸气的深度，防止呼气表浅。宗气的生成有两个来源：一是脾胃运化的水谷之精所化生的水谷精气，一是肺从自然界中吸入的清气，两者结合生成宗气（C错）。元气指以先天精气为基础，赖后天精气充养，而根源于肾的气，而非肾所摄纳之气（B错）。营气来源于脾胃运化之水谷精微，由水谷精微中的精华部分，即最富营养的部分所化生（E错）。